下列哪种物质不是细菌的代谢产物
A. 侵袭酶
B. 热原质
C. 维生素
D. 激素
E. 色素

正确答案：D。激素

解析：细菌通过合成代谢不断合成菌体成分，此外，还合成许多在医学上具有重要意义的代谢产物，如热原质、毒素（包括内毒素和外毒素）、侵袭性酶、色素、细菌素、抗生素和维生素等，前3种是细菌的致病物质，与细菌的致病性有关。不同的细菌产生的不同色素和细菌素，可用于细菌的鉴定。抗生素和维生素则是用于临床治疗的药物。掌握“细菌的生理”知识点。